主动脉裂孔位于
A. 左膈脚与脊柱间
B. 右膈脚与脊柱间
C. 左、右膈脚与脊柱间
D. 中心腱与脊柱间
E. 无

正确答案：C。左、右膈脚与脊柱间

解析：主动脉裂孔位于左、右膈脚与脊柱间（C对）。